随着龋病的发生，牙菌斑内哪些细菌数量下降
A. 变形链球菌
B. 血链球菌
C. 乳杆菌
D. 放线菌
E. 酵母菌

正确答案：B。血链球菌

解析：本题考查龋病。随着龋病的发生，牙菌斑内血链球菌（B对）数量下降。在龋病发病期间变形链球菌（A错）、放线菌（D错）、乳杆菌（C错）和酵母菌（E错）数量增加，而血链球菌和韦永菌数量减少。